以下关于结核病流行状况中错误的是
A. 结核病的流行存在明显的地区差异
B. 中国是世界上仅次于印度的结核病高负担国家
C. 98%的结核病死亡发生在发达国家
D. 目前全球约有1/3的人感染了结核分枝杆菌
E. 结核病在贫困落后的国家和地区流行严重

正确答案：C。98%的结核病死亡发生在发达国家